妊娠9周行吸宫流产术时，出血量多，首要的处理是
A. 输液输血
B. 按摩子宫
C. 排空宫腔内容物
D. 静脉注射止血剂
E. 肌内注射止血剂

正确答案：C。排空宫腔内容物

解析：人工流产负压吸宫术适用于妊娠10周以内者，但妊娠月份越大时，因子宫较大，子宫收缩欠佳，出血量较多。首要的处理是，应在扩张宫颈后，尽快取出胎盘及胎体，排空宫腔内容物（C对），出血往往迅速停止，这是止血的有效方法。从腹部用手指按摩子宫，或双合诊按摩与压迫子宫体（第2版实用妇产科学P1029）（B错），可促进宫缩，控制出血，不作为首要处理方法。输液输血（A错）、使用止血剂（DE错）都是一般性治疗措施，用于出血量多的患者。